患者自汗易感冒，可首选下列哪组穴位进行保健灸法
A. 神阙，中脘
B. 大椎，三阴交
C. 气海，合谷
D. 大椎，足三里
E. 关元，曲池

正确答案：E。关元，曲池

解析：患者自汗易感冒属于气虚。气虚自汗，人在醒时容易出汗，活动汗出加重；还容易造成反复感冒，或是感冒长期不愈。艾灸关元、曲池，可以增强正气、提高身体的免疫力（E对ABCD错）。